中药饮片贮存过程中，易发生吸潮粘连和发霉的饮片是
A. 黄柏
B. 天冬
C. 苦参
D. 大黄
E. 川芎

正确答案：B。天冬

解析：本题考查的是中药饮片贮存中常见的质量变异现象。中药饮片贮存过程中，易发生吸潮粘连和发霉的饮片是天冬（B对）。霉变：是指饮片受潮后在适宜温度条件下，引发寄生在其表面或内部的霉菌大量繁殖，导致发霉的现象。霉变对饮片的危害仅次于虫蛀。我国地处温带，特别是长江以南地区，夏季炎热、潮湿，饮片最易发霉。霉变饮片不能再供药用。当霉菌在潮湿的环境下，遇到适宜的温度（20～35℃），即可萌发菌丝，并分泌酵素，侵蚀饮片组织内部，使其腐烂变质、气味走失，而且有效成分也遭到很大的破坏，以致不能药用。凡含有糖类、黏液质、淀粉、蛋白质及油类的饮片较易霉变，如牛膝、天冬、马齿苋、菊花、蕲蛇、五味子、人参、独活、紫菀等。此外中药鲜药因含水量较多，也容易发生霉变。粘连：是指有些固体饮片，由于熔点较低，遇热则发黏而粘结在一起，或含糖分较高的饮片，吸潮后粘结在一起，使原来形态发生改变的现象。如芦荟、没药、乳香、阿魏、鹿角胶、龟甲胶、天冬、熟地等。黄柏（A错）易发生变色。变色，是指饮片的色泽起了变化，如由浅变深或由鲜变暗等。各种饮片都有其固有的色泽，这也是中药饮片检查中的主要质量标志之一。饮片变色，是由于所含色素受到外界影响（如温度和湿度、日光、霉变、化学药剂的使用、硫黄熏蒸等）使饮片失去了其原有的色泽，影响饮片质量。比如硫黄熏后，产生的二氧化硫遇水成亚硫酸，具有还原作用，可使饮片褪色；再如由于保管不善，某些饮片的颜色由浅变深，如泽泻、白芷、山药、天花粉等；有些饮片由深变浅，如黄芪、黄柏等；有些饮片由鲜艳变暗淡，如红花、菊花、金银花、梅花等花类药。因此，色泽的变化可以直接反映其内在质量。苦参（C错）属于易生虫饮片。大黄（D错）易发生虫蛀。虫蛀，是指饮片被虫蛀蚀，从而降低疗效或失去药用价值的现象。虫蛀对中药的危害较为严重，是一种常见的质量异常现象。淀粉、糖、脂肪、蛋白质等成分，是有利于蛀虫生长繁殖的营养物质，故含上述成分较多的饮片最易生虫，如白芷、北沙参、薏苡仁、柴胡、大黄、鸡内金等。川芎（E错），属于易失去气味饮片。